全蚀刻体系是指
A. 能酸蚀釉质的制剂
B. 能酸蚀牙本质的制剂
C. 能酸蚀牙骨质的制剂
D. 既酸蚀釉质又能酸蚀牙本质的制剂
E. 既酸蚀牙本质又能酸蚀牙骨质的制剂

正确答案：D。既酸蚀釉质又能酸蚀牙本质的制剂

解析：本题考查牙体粘接材料与技术。全蚀刻体系是指既酸蚀釉质又能酸蚀牙本质的制剂（D对），是一种应用广泛的酸蚀剂，酸蚀能力比釉质酸蚀剂强，比牙本质酸蚀剂酸蚀能力弱。能酸蚀釉质的制剂称牙釉质蚀刻剂（A错）。能酸蚀牙本质的制剂称牙本质蚀刻剂（B错）。尚未研制专门能酸蚀牙骨质的制剂（C错），也没有既酸蚀牙本质又能酸蚀牙骨质的制剂（E错）。